胎儿发育异常的分类错误的是
A. 胎儿宫内发育迟缓
B. 脑积水
C. 连体儿
D. 死胎
E. 葡萄胎

正确答案：E。葡萄胎

解析：胎儿发育异常：1.巨大胎儿。胎儿出生体重≥4000g，多见于经产妇、过期妊娠、糖尿病及父母身材高大者。2.脑积水。脑室内外有大量脑脊液蓄积，使颅缝明显增宽，颅腔体积增大，囟门明显增大，压迫正常脑组织；3.联体双胎畸形。临床上以胸与胸、背与背、头与头、臀与臀等相同部位相连，腹部检查与双胎妊娠不易区别，B型超声检查可协助诊断。处理原则为保护母体免受损伤，一旦发现应及早终止妊娠。胎儿发育异常不包括葡萄胎（E错，为本题正确答案），葡萄胎为妊娠后胎盘绒毛滋养细胞异常增生，终末绒毛转变为水泡，水泡间相连成串，形如葡萄状。